患者眩晕，精神萎靡，健忘多梦，腰膝酸软，四肢不温，形寒怯冷，舌质淡，脉沉细无力。治疗应首选
A. 左归丸
B. 右归丸
C. 大定风珠
D. 大补元煎
E. 附子理中丸

正确答案：B。右归丸

解析：患者精髓不足，不能上承于脑，故眩晕，精神萎靡；肾精亏虚，故见腰膝酸软；肾虚心肾不交故见健忘多梦；偏阳虚则生内寒，故见四肢不温，形寒怯冷；舌质淡，脉沉细无力均属肾阳虚之侯，治法为温肾助阳，治疗选右归丸（B对）。左归丸（A错）滋补肾阴，填精益髓，治疗真阴不足证。大定风珠（C错）滋阴熄风，治疗阴虚风动证。大补元煎（D错）益肾补元。附子理中丸（E错）温阳去寒，益气健脾，主治脾胃虚寒较甚，或脾肾阳虚证。